细胞浆内出现大小不等，圆形均质红染物质的病变，见于
A. 纤维化肾小球
B. 纤维瘢痕组织
C. 高血压病时细动脉
D. 动脉粥样硬化的纤维斑块
E. 慢性肾小球肾炎的肾小管

正确答案：E。慢性肾小球肾炎的肾小管

解析：慢性肾小球肾炎时，肾小球滤过屏障受损，导致原尿中的蛋白质含量增加，部分蛋白质可蓄积于肾小管上皮细胞中，引起肾小管上皮细胞内玻璃样变。而细胞浆内出现大小不等，圆形均质红染物质的病变正是细胞内玻璃样变的表现，因此可见于慢性肾小球肾炎的肾小管中（E对）。纤维化肾小球（A错）即肾小球纤维化，是指肾小球经过增生、硬化逐步转向纤维化的过程，常见于肾小球炎症、高血压引起的肾脏病变中。高血压病时，细动脉（C错）最主要的表现是细动脉壁玻璃样变（P140），即间质内出现红染、均质的玻璃样变物质（P17 图1-12），而不是在细胞浆内出现。动脉粥样硬化的纤维斑块（P17）（D错）属于纤维结缔组织的玻璃样变，是纤维组织老化的表现，其特点是陈旧的胶原纤维增粗并互相融合成均质红染的梁状、带状或片状，失去纤维性结构。